关于下颌切牙拔除描述哪项是正确的
A. 下颌切牙与上颌切牙牙根外形类似可使用旋转力
B. 下颌切牙牙根较细易折断，不可使用旋转力
C. 下颌切牙牙根较细易折断，可稍加旋转力
D. 下颌切牙牙根较细但不易折断，故摇动力和旋转力可同时使用
E. B+D

正确答案：B。下颌切牙牙根较细易折断，不可使用旋转力

解析：本题考查下颌切牙拔除术。牙拔除过程的用力的形式及方向要与牙的解剖特点相适应。下颌切牙与上颌切牙牙根外形类似，但相比上颌切牙而言，牙根较扁平，较细易折断，不可使用旋转力（B对）。